小儿生理特点中所说的“稚阴稚阳”的含义是
A. 生机蓬勃，发育迅速
B. 脏腑娇嫩，形气未充
C. 年龄越小，生长越快
D. 年龄越小，发育越快
E. 纯阳无阴，阳常有余

正确答案：B。脏腑娇嫩，形气未充

解析：古代儿科医家将小儿脏腑娇嫩，形气未充的特点，概括为“稚阴稚阳”，“稚阴”指的是精、血、津液，也包括脏腑、筋骨、脑髓、血脉、肌肤等有形之质，皆未充实、完善。所谓“稚阳”指的是各脏腑功能活动均属于幼稚不足和处于不稳定状态。“稚阴稚阳”是说明小儿在物质基础与生理功能上都是幼稚和不完善的，需要不断地生长发育，充实完善（B对）。生机蓬勃，发育迅速（A错）是儿童的另一生理特点，亦可以称之为“纯阳”。年龄越小，生长越快（C错）和年龄越小，发育越快（D错）表述片面，不符合题意。纯阳无阴，阳常有余（E错）前者指阳气偏亢、阴气耗竭，为危重证候；后者为朱丹溪的观点，认为饮食失节，嗜酒纵欲，伤伐过度，则阳热易亢，虚火妄动，故阳常有余，不符合题意。